胃痛的主穴为
A. 上脘、中脘、下脘
B. 上脘、天枢、阴陵泉
C. 内关、阳陵泉、上脘
D. 内关、足三里、中脘
E. 上巨虚、内关、下脘

正确答案：D。内关、足三里、中脘

解析：胃痛治宜和胃止痛，以足阳明、手厥阴经穴及相应募穴为主。选取中脘、内关、足三里作为主穴（D对）。